哪项不是构成抗原的条件
A. 大分子物质
B. 异物性
C. 有一定的化学组成和结构
D. 非经口进入机体
E. 必须与载体相结合

正确答案：E。必须与载体相结合